氯丙嗪抗精神病的作用机制是阻断
A. 中枢α肾上腺素能受体
B. 中枢β肾上腺素能受体
C. 中脑边緣系和中脑皮质通路D₂受体
D. 黑质纹状体通路中的5-HT受体
E. 结节漏斗通路的D₂受体

正确答案：C。中脑边緣系和中脑皮质通路D₂受体